关于城市公共安全规划的对象，错误的是
A. 包括城市工业危险源、城市公共基础设施
B. 包括城市突发公共卫生事件、城市自然灾害
C. 包括城市美化和市容市貌
D. 包括城市社会安全事件和恐怖袭击破坏
E. 包括城市重要机构和公共场所

正确答案：C。包括城市美化和市容市貌

解析：本题考查城市公共安全规划的对象。城市公共安全规划是通过对城市风险进行分析研究，为最大化地降低突发事件对城市的不利影响，而对城市用地、设施以及人类活动进行的空间和时间上的安排。其对象包括：工业危险源、公共基础设施（A对）、重要机构和公共场所（E对）、突发公共卫生事件、自然灾害（B对）、社会安全事件和恐怖袭击破坏（D对）、应急救援力量以及应急救援设备设施等。城市美化和市容市貌（C错，为本题正确答案）不是城市公共安全规划的对象。